哪项描述与混合瘤的临床表现不符
A. 可发生于任何年龄，以30～50岁多见
B. 一般结节性肿块
C. 肿瘤质地硬，呈结节状
D. 肿瘤生长缓慢，可伴有明显疼痛
E. 混合瘤常发生于腮腺

正确答案：D。肿瘤生长缓慢，可伴有明显疼痛

解析：多形性腺瘤生长缓慢，常无自觉症状，病史较长。掌握“多形性腺瘤”知识点。